男，75岁。反复上腹痛30余年，消瘦、黑便3个月。10余年前胃镜检查诊断为“慢性萎缩性胃炎”。本次胃镜检查示：胃皱襞减少，黏膜不平，黏膜下血管透见，胃窦可见直径2cm深溃疡，周边隆起，溃疡周边活检病理学检查，最不可能出现的病理改变是
A. 胃腺癌
B. 胃窦黏膜异型增生
C. 胃体黏膜主细胞数量减少
D. 胃体黏膜壁细胞数量增加
E. 胃窦黏膜肠上皮化生

正确答案：D。胃体黏膜壁细胞数量增加

解析：老年男性患者，慢性萎缩性胃炎病史十余年，消瘦、黑便3个月。胃镜检查显示胃皱襞减少，黏膜不平、黏膜下血管透见，胃窦见一周边隆起的深溃疡，考虑诊断为慢性萎缩性胃炎并发恶性溃疡。胃体黏膜主细胞数量减少（C对）、壁细胞数量减少（D错，为本题正确答案）和肠上皮化生（E对）均为萎缩性胃炎的典型病理改变。恶性溃疡可逐渐进展，出现胃窦黏膜异型增生（B对），并最终发展为胃腺癌（A对）。